初产妇第一产程潜伏期延长是指潜伏期超过
A. 8小时
B. 10小时
C. 12小时
D. 20小时
E. 18小时

正确答案：D。20小时

解析：潜伏期指从临产出现规律宫缩至宫口扩张3cm。此期间扩张速度较慢，平均2～3小时扩张1cm，需8小时，最大时限16小时。初产妇第一产程潜伏期延长是指潜伏期超过16小时（八版妇产科学P206）根据九版妇产科学：初产妇＞20小时、经产妇＞14小时称为潜伏期延长（D对）。